患者，女，45岁。诊断为高血压合并甲状腺功能亢进，心率过快，宜选用的抗高血压药是
A. 普萘洛尔
B. 氨氯地平
C. 吲达帕胺
D. 赖诺普利
E. 特拉唑嗪

正确答案：A。普萘洛尔

解析：本题考查普萘洛尔。高血压合并甲状腺功能亢进，心率过快，宜选用的抗高血压药是普萘洛尔（A对）。普萘洛尔为β受体阻断剂，可使心率减慢，用于控制甲状腺功能亢进症引起的心率过快。氨氯地平（B错）属于钙通道阻滞剂，能够松弛血管平滑肌，降低心肌收缩力，减少心肌耗氧，改善心肌供血，保护缺血心肌细胞，发挥抗心绞痛作用；同时也能够降低血压，用于高血压的治疗。吲达帕胺（C错）为噻嗪类利尿药，具有血管扩张作用，降压疗效与常规剂量的氨氯地平相同，对收缩压和舒张压均有降低作用，疗效强于氢氯噻嗪，用于轻重度高血压。赖诺普利为（D错）ACEI类抗高血压药物，禁忌：高钾血症、妊娠期妇女、双侧肾动脉狭窄。特拉唑嗪（E错）为α₁受体阻断药，可以使前列腺平滑肌松弛，减轻下尿路症状，使尿流通畅，因此伴良性前列腺增生的高血压患者适合选用。